结肠破裂
A. 腹膜炎出现早
B. 腹膜炎较轻，呈板状腹
C. 腹膜炎出现较晚，但较重
D. 腹膜炎出现较晚且较轻
E. 无腹膜刺激征

正确答案：C。腹膜炎出现较晚，但较重

解析：结肠破裂腹膜炎出现较晚，但较重（C对ABDE错）。结肠的消化活动少，主要功能在于吸收水份和无机盐，同时为食物吸收后的残渣提供储存的场所，并将食物残渣转变为粪便，结肠液较少，破裂后结肠液经腹膜吸收需一段时间后才会引起腹膜炎，但是由于结肠液中所含细菌数量多，一经吸收会引起严重的继发性腹膜炎，甚至出现感染性休克。